驱虫药的服用时间是
A. 饭前服
B. 空腹服
C. 饭后服
D. 定时服
E. 睡前服

正确答案：B。空腹服

解析：该题考查的是驱虫药的服用方法。驱虫药一般应在空腹时服用，使药物充分作用于虫体而保证疗效。